提高难溶性药物溶出率和生物利用度的方法为
A. 膜分离技术
B. 吸附澄清
C. 药物微粉化
D. 超临界萃取
E. XX制粒

正确答案：C。药物微粉化

解析：本题考查的是药物微粉化。提高难溶性药物溶出率和生物利用度的方法为药物微粉化（C对）。中药制剂研制的指导思想是提高原方药的疗效，至少不能减弱治疗效果。增强中药制剂的治疗作用可从药物本身的性质或治疗目的出发，通过制剂克服其弱点，充分发挥其作用。如研制难溶药物的口服制剂，可采用增（助）溶技术、固体分散技术、环糊精包合技术、微粉化技术、微乳技术等改善药物溶解度或溶出速度以促进吸收，提高生物利用度。口服液制备时，根据制备需要可酌情采用膜分离技术（A错）、大孔树脂吸附分离技术，以及其他精制技术对饮片浸提液进一步分离纯化，以减少服用剂量、提高澄清度。药液经滤过或高速离心除去沉淀，也可进一步采用乙醇沉淀法、吸附澄清法（B错）等除去不溶性或高分子絮状沉淀物。在提取工艺路线初步确定后，应充分考虑可能影响提取效果的因素，进行科学、合理的实验设计，采用准确、简便、具代表性、可量化的综合性评价指标与方法，优选合理的提取工艺条件。在有成熟的相同技术条件可借鉴时，可通过提供相关文献资料，作为制订合理的工艺技术条件依据。但是，通常是将有关工艺的诸多因素，采用正交试验设计、均匀试验设计、星点设计效应面优化法等，筛选最佳工艺条件。目前，超临界流体萃取（D错）、闪式提取、微波萃取、超声提取等中药现代提取技术为中药原料药的制备提供了更多选择。